能够帮助医师决策和筛选临床关键技术；也能帮助患者选择合适的治疗方法的是
A. 根管充填
B. 根管器械的好坏
C. 根管冲洗的干净程度
D. 根管治疗的评价
E. 开髓洞型的标准程度

正确答案：D。根管治疗的评价

解析：根管治疗的疗效评价是根管治疗的重要临床组成部分，它提供的信息帮助医师观察和确定新技术的临床效果，决策和筛选临床关键技术；也可以帮助患者选择合适的治疗方法。掌握“疗效评定与牙体修复原则”知识点。